女，58岁。绝经8年，不规则阴道流血2周，5年前普查发现子宫肌瘤，高血压10余年治疗中，查体肥胖。妇科查体：子宫如妊娠8周，稍软，轻压痛。宫颈轻度糜烂，B型超声显示子宫内膜厚而不规则。经病理确诊后首选的治疗方法是
A. 手术治疗
B. 化学治疗
C. 放射治疗
D. 抗炎治疗
E. 中医药治疗

正确答案：A。手术治疗

解析：该患者为老年女性，出现绝经后不规则阴道流血（子宫内膜癌的主要表现为绝经后阴道不规则流血），查体肥胖（肥胖为子宫内膜癌的高危因素）。妇检：子宫增大（晚期可有子宫增大），B型超声显示子宫内膜厚而不规则（典型子宫内膜癌的超声图像有宫腔有实质不均匀回声区，或宫腔线消失，肌层内有不均匀回声区），考虑子宫内膜癌。经病理确诊后首选的治疗方法是手术治疗（A对），手术目的一是进行手术-病理分期，确定病变范围及与预后相关因素，二是切除病变子宫及其他可能存在的转移病灶。化学治疗（P317）（B错）是晚期或复发子宫内膜癌综合治疗措施之一。放射治疗（P317）（C错）仅用于有手术禁忌症或无法手术切除的晚期患者。抗炎治疗（D错）、中医药治疗（E错）不是治疗子宫内膜的常见措施。